砷引起的食物中毒可引起多种脏器受损，主要有
A. 神经细胞受损引起神经系统病变
B. 实质性器官如肝肾发生病变
C. 损害血管，造成全身性出血
D. 对黏膜产生强烈的腐蚀作用
E. 以上都是

正确答案：E。以上都是